肿瘤的特异性治疗是
A. 注射麻疹疫苗
B. 注射短棒状杆菌疫苗
C. 注射异体肿瘤免疫核糖核酸
D. 注射干扰素
E. 注射转移因子

正确答案：C。注射异体肿瘤免疫核糖核酸

解析：肿瘤的特异性治疗是注射自体或异体肿瘤免疫核糖核酸（C对）、瘤苗等，使宿主免疫系统产生针对肿瘤抗原的抗肿瘤免疫应答。注射麻疹疫苗（A错）、注射短棒状杆菌疫苗（B错）、注射干扰素（D错）和注射转移因子（E错）都属于肿瘤的非特异性治疗。